小儿热速清口服液除清热外，还能
A. 养阴润燥利咽
B. 宣肺止咳祛痰
C. 解表化痰止嗽
D. 疏风清热宣肺
E. 解毒泻火利咽

正确答案：E。解毒泻火利咽

解析：本题考查的是小儿热速清口服液的功能。小儿热速清口服液除清热外，还能解毒泻火利咽（E对）。小儿热速清口服液：【功能】清热解毒，泻火利咽。养阴清肺膏：【功能】养阴润燥，清肺利咽（A错）。小儿咳喘灵颗粒：【功能】宣肺清热，止咳祛痰（B错），平喘。儿童清肺丸：【功能】清肺，解表，化痰，止嗽（C错）。清宣止咳颗粒：【功能】疏风清热，宣肺止咳（D错）。